某研究用甲、乙两种方法同时测量某市9处水源中氟含量（mg/L），采用Wilcoxon符号秩和检验比较两种方法的测量结果是否不同。正确的编秩方法是按两组
A. 差值从小到大编秩
B. 差值的绝对值从小到大编秩
C. 原始值从小到大分别编秩
D. 原始值从大到小统一编秩
E. 原始值的绝对值从小到大统一编秩

正确答案：B。差值的绝对值从小到大编秩